男，25岁，过量饮酒后，被同桌酒友送到医院，酒友在未支付医疗费的情况下，匆忙离开医院，医院无法联系到患者的家人。此时，患者血压下降，面色苍白，皮肤湿冷，瞳孔散大。经首诊医师初步判断，为急性酒精中毒，经全力抢救后，患者已经转危为安了。需要遵循的急诊抢救原则是
A. 分秒必争的抢救患者
B. 满足心理需求
C. 遵从社会公益
D. 患者家属知情同意
E. 团结协作

正确答案：A。分秒必争的抢救患者

解析：急救的基本原则是生命第一，在疾病诊治时优先处理危及生命安全的疾病（A对）。